在一项近期口服避孕药与心肌梗死关系的研究中，已知年龄的混杂偏倚值是﹣0.577，该偏倚是
A. 正混杂偏倚
B. 负混杂偏倚
C. 因为该值太小，尚不能说存在混杂偏倚
D. 该值的大小只能说明混杂的程度，不能说明混杂的方向

正确答案：B。负混杂偏倚

解析：本题考查混杂偏倚。口服避孕药与心肌梗死关系的研究中，已知年龄的混杂偏倚值是﹣0.577，该偏倚是负混杂偏倚（B对ACD错），负混杂偏倚是指混杂因素的存在使暴露因素与疾病之间的联系被缩小。正负表示方向，而不是数值的大小。